支配瞳孔括约肌的节后纤维发自
A. 动眼神经副核
B. 翼腭神经节
C. 下颌下神经节
D. 耳神经节
E. 睫状神经节

正确答案：E。睫状神经节

解析：睫状神经节（E对）为副交感神经节，其短根为副交感根，来自动眼神经中的内脏运动纤维在此节交换神经元，自节内神经元发出节后纤维加入睫状短神经进入眼球，支配瞳孔括约肌和睫状肌。动眼神经副核（A错）发出节前纤维止于睫状神经节，支配瞳孔括约肌。翼腭神经节（B错）主要控制泪腺、鼻甲、腭的分泌。下颌下神经节（C错）主要分布于舌下腺和下颌下腺。耳神经节（D错）主要控制腮腺的分泌。